目前中药含量测定最常用的色谱法是
A. 薄层色谱扫描法
B. 气相色谱法
C. 高效液相色谱法
D. 蛋白电泳色谱法
E. 高效毛细管电泳法

正确答案：C。高效液相色谱法

解析：本题考查的是高效液相色谱法。目前中药含量测定最常用的色谱法是高效液相色谱法（C对）。高效液相色谱法（HPLC）：HPLC法是目前中药含量测定中最常用的方法。《中国药典》一部中采用HPLC法进行含量测定的有2236项，占所有含量测定项数的86.5%。HPLC的定量分析方法主要有内标法、外标法、主成分自身对照法、面积归一化法，此外还有新采用的一测多评法。气相色谱法（B错）（GC）：GC法的测定对象主要是易于挥发、热稳定性好的样品，如含挥发油或其他挥发性成分的中药。薄层色谱扫描法（A错）、蛋白电泳色谱法（D错）与高效毛细管电泳法（E错），2022年考试指南未明确说明。